骨骼与心肌细胞中的脱氨基方式是
A. 甲硫氨酸循环
B. 嘌呤核苷酸循环
C. γ谷氨酰基循环
D. 鸟氨酸循环
E. 丙氨酸葡萄糖循环

正确答案：B。嘌呤核苷酸循环